其外毒素作用于神经肌肉接头处引起弛缓性麻痹的细菌是
A. 产气荚膜梭菌
B. 破伤风梭菌
C. 无芽胞厌氧菌
D. 肉毒杆菌
E. 艰难梭菌

正确答案：D。肉毒杆菌

解析：本题考查外毒素作用于神经肌肉接头处引起弛缓性麻痹的细菌。其外毒素作用于神经肌肉接头处引起弛缓性麻痹的细菌是肉毒杆菌（D对）。产气荚膜梭菌（A错）能产生多种外毒素，其中α毒素毒性最强最重要，可造成细胞溶解，所致疾病包括气性坏疽、食物中毒等。破伤风梭菌（B错）是破伤风的病原菌，可产生破伤风溶血毒素和破伤风痉挛毒素2种外毒素，后者属于神经毒素，可作用于神经系统，引起痉挛性麻痹。无芽胞厌氧菌（C错）是寄生于人体体表及与外界相通腔道中的正常菌群，可作为机会致病菌导致内源性感染，包括败血症、中枢神经系统感染、口腔感染、呼吸道感染、腹部和会阴部感染、女性生殖道和盆腔感染等。艰难梭菌（E错）是人类肠道中正常菌群之一，当患者长期使用或不规范使用某些抗生素以后，可引起肠道内的菌群失调，耐药的艰难梭菌可产生肠毒素和细胞毒素，可导致抗生素相关性腹泻和家模型结肠炎等疾病。